男，31岁。头痛进行性加重1个月。入院前3天出现喷射状呕吐3次，抽搐1次。查体：神志清楚，双侧视神经乳头水肿，颈软。最可能的诊断是
A. 颅内压增高
B. 蛛网膜下腔出血
C. 脑软化
D. 陈旧性脑梗死
E. 脑血管畸形

正确答案：A。颅内压增高

解析：中年男性患者，头痛进行性加重1个月。入院前3天出现喷射状呕吐3次，抽搐1次。查体：神志清楚，双侧视神经乳头水肿，颈软。综合患者的症状、体征和辅助检查，最可能的诊断是颅内压增高（A对）。蛛网膜下腔出血（B错）头痛剧烈，多有情绪激动、便秘、咳嗽等诱因。脑软化（C错）无喷射状呕吐及视神经乳头水肿的表现。陈旧性脑梗死（D错）多见于45～70岁中老年人，起病突然。脑血管畸形（E错）多有外伤史，临床上表现为头痛、出血、癫痫等，脑血管造影提示血管畸形。